糖皮质激素可用于
A. 中毒性菌痢
B. 神经性皮炎
C. 虹膜炎
D. 急慢性白血病
E. 一般病毒感染

正确答案：A、B、C、D。中毒性菌痢；神经性皮炎；虹膜炎；急慢性白血病

解析：本题考查糖皮质激素。糖皮质激素的临床应用：①急、慢性肾上腺皮质功能减退（包括肾上腺危象）、脑垂体前叶功能减退及肾上腺次全切除术后作替代疗法。②严重感染并发的毒血症，如中毒型痢疾（A对）、中毒性肺炎、暴发型流行性脑脊髓膜炎、暴发型肝炎等。③自身免疫性疾病，如风湿热、风湿性心肌炎、风湿性关节炎及类风湿关节炎、全身性红斑狼疮、结节性动脉周围炎、皮肌炎、自身免疫性贫血和肾病综合征等，一般采用综合疗法。异体器官移植术后产生的免疫排异反应也可用糖皮质激素。④过敏性疾病，如荨麻疹、枯草热、血清病、血管神经性水肿、过敏性鼻炎、神经性皮炎（B对）、支气管哮喘和过敏性休克等，通过糖皮质激素抗炎、抗过敏作用缓解症状而达到治疗效果。⑤缓解急性炎症的各种症状，并可防止某些炎症的后遗症，如组织粘连、瘢痕。可用于结核性脑膜炎、胸膜炎、心包炎、虹膜炎（C对）、角膜炎、视网膜炎、视神经炎、睾丸炎和烧伤等。⑦各种原因引起的休克。⑧血液系统疾病，如白血病（D对）、恶性淋巴瘤、再生障碍性贫血、白细胞及血小板减少等。⑨其他肌肉和关节劳损，严重天庖疮、剥脱性皮炎，溃疡性结肠炎及甲状腺危象等。一般病毒感染（E错）不应用糖皮质激素，因为本类药物抑制炎性反应和免疫反应，降低机体防御功能，反而有可能使潜在的感染灶活动和扩散。